根尖切除术的适应证
A. 根管充填不完善，根尖周病变久治不愈
B. 器械折断于根管内，堵塞不通
C. 根尖周肉芽肿
D. 慢性根尖周脓肿
E. 牙周病变涉及根尖周组织

正确答案：B。器械折断于根管内，堵塞不通

解析：适应证：①根管治疗术失败而无法除去原有根管充填材料的根尖周病患牙；②根管钙化、根管严重弯曲或已做桩冠修复而未能行根管治疗的根尖周病患牙；③根管器械折断在根管内取不出或折断器械超出根尖孔，且根尖周病变不愈者；④根尖折断或移位已形成慢性根尖周炎者；⑤难于取出的超填根管充填料，且根尖周病变不愈者；⑥由内吸收、外吸收或医源性引起的根管穿孔或外吸收者；⑦一般只用于前牙和前磨牙，磨牙根据解剖情况可酌情考虑。禁忌证：①患牙位置邻近重要器官，有损伤危险或带来严重后果者；②严重的全身疾病，如高血压、血友病、重度贫血、心内膜炎、风湿性心脏病、糖尿病、肾炎及有出血倾向疾病等；③急性根尖周炎的急性期。故此题选择B项。掌握“根尖手术”知识点。